功能发汗解表、宣肺平喘、利水消肿的药物是
A. 麻黄
B. 桂枝
C. 紫苏
D. 生姜
E. 白芷

正确答案：A。麻黄

解析：本题考查的是麻黄的功效。功能发汗解表、宣肺平喘、利水消肿的药物是麻黄（A对）。麻黄：【功效】发汗解表，宣肺平喘，利水消肿。桂枝（B错）：【功效】发汗解肌，温通经脉，助阳化气。紫苏（C错）：【功效】发表散寒，行气宽中，安胎，解鱼蟹毒。生姜（D错）：【功效】发汗解表，温中止呕，温肺止咳。白芷（E错）：【功效】发散风寒，通窍止痛，燥湿止带，消肿排脓。